胸痛憋闷，痛引肩臂者为
A. 胸痹
B. 真心痛
C. 痰湿犯肺
D. 肝气郁滞
E. 肝火犯肺

正确答案：A。胸痹

解析：胸居上焦，内藏心肺，故胸痛多与心肺病变有关。胸痛憋闷，痛引肩臂者，多因痰、瘀等邪阻滞心脉所致，可见于胸痹（A对）等病。厥心痛（真心痛）患者表现为胸背彻痛剧烈，面色青灰，手足青至节（B错）。痰湿犯肺，可出现咳嗽咳痰，痰液清稀量多等（C错）。肝气郁滞则胸胁、少腹胀满窜痛，且与情志因素相关（D错）。肝火犯肺则胸胁灼痛，急躁易怒（E错）。